板蓝根药材的鉴别特征有
A. 根头部略膨大，可见轮状排列的暗棕色叶柄残基
B. 断面可见数轮同心环纹
C. 气微，味微甜而后苦涩
D. 薄壁细胞含草酸钙簇晶
E. 水煎液置紫外灯下观察显蓝色荧光

正确答案：A、C。根头部略膨大，可见轮状排列的暗棕色叶柄残基；气微，味微甜而后苦涩

解析：本题考查的是板蓝根药材的性状鉴别。板蓝根药材的鉴别特征有根头部略膨大，可见轮状排列的暗棕色叶柄残基（A对）与气微，味微甜而后苦涩（C对）。板蓝根：【性状鉴别】药材呈圆柱形，稍扭曲。表面淡灰黄色或淡棕黄色，有纵皱纹、横长皮孔样突起及支根痕。根头略膨大，可见暗绿色或暗棕色轮状排列的叶柄残基和密集的疣状突起。体实，质略软，断面皮部黄白色，木部黄色。气微，味微甜后苦涩。断面可见数轮同心环纹（B错）的有川牛膝、商陆等。薄壁细胞含草酸钙簇晶（D错）的有白芍、丁香等。水煎液置紫外灯下观察显蓝色荧光（E错）的为羟基香豆素类化合物。香豆素母体本身无荧光，而羟基香豆素在紫外光下多显出蓝色荧光，在碱溶液中荧光更加显著。